患者，女，30岁。患系统性红斑狼疮，长期大量服用糖皮质激素治疗。其不良反应是
A. 血糖降低
B. 血压降低
C. 红细胞数目减少
D. 淋巴细胞增多
E. 体内脂肪重新分布

正确答案：E。体内脂肪重新分布

解析：长期大剂量应用糖皮质激素可导致医源性肾上腺皮质功能亢进症，引起物质代谢和水盐代谢紊乱，引起脂肪重新分布（E对），表现为满月脸、水牛背、向心性肥胖、皮肤变薄、多毛、浮肿、血钾降低、高血脂、高血糖（A错）、高血压（B错）等，一般不需要治疗，停药后即可消退，必要时可使用降压药、降血糖药进行治疗以减轻症状。引起骨质疏松，延缓伤口愈合；引起前房角小梁网结构胶原束肿胀诱发青光眼，还可致晶状体浑浊引起白内障；糖皮质激素还可抑制生长激素分泌和造成负氮平衡，可影响儿童生长发育，但对红细胞（C错）以及淋巴细胞（D错）计数无明显影响。